子宫动脉起于
A. 髂内动脉
B. 髂外动脉
C. 闭孔动脉
D. 阴部内动脉
E. 无

正确答案：A。髂内动脉

解析：髂内动脉（A对）为子宫动脉、闭孔动脉、阴部内动脉等动脉的起始部。